注射青霉素过敏引起的过敏性休克是
A. 副作用
B. 后遗效应
C. 应激效应
D. 毒性反应
E. 变态反应

正确答案：E。变态反应